诊断休克失代偿期必备的条件是
A. 脉率＞90次/分
B. 收缩压＜90mmHg
C. 脉压＜20mmHg
D. 谵妄
E. 四肢末梢皮肤湿冷

正确答案：B。收缩压＜90mmHg

解析：在休克失代偿期，可出现以下表现：神情淡漠、反应迟钝，甚至可出现意识模糊或昏迷；出冷汗、口唇肢端发绀；脉搏细速、血压进行性下降。严重时，全身皮肤、黏膜明显发绀，四肢厥冷，脉搏摸不清、血压测不出，尿少甚至无尿。若皮肤、黏膜 出现淤斑或消化道出血，提示病情已发展至弥散性血管内凝血阶段。若出现进行性呼吸困难、脉速、烦躁、发绀，一般吸氧而不能改善呼吸状态，应考虑并发急性呼吸窘迫综合（B对ACDE错）。